白天由于太阳加热沿岸陆地的速度比加热水面快，形成了由水面吹向陆地的风，称为
A. 山风
B. 谷风
C. 海风
D. 陆风
E. 城市热岛

正确答案：C。海风

解析：本题考查海风。白天由于太阳加热沿岸陆地的速度比加热水面快，形成了由水面吹向陆地的风，称为海风（C对ABDE错）。